累及一侧肢体的早期或年龄轻的帕金森病治疗的最佳选用药物为
A. 美多巴
B. 左旋多巴
C. 安坦
D. 培高利特
E. 恩他卡朋

正确答案：D。培高利特